太阳经头痛的特点为
A. 两侧太阳穴附近痛甚
B. 前额部连及眉棱骨痛
C. 巅顶痛
D. 后头痛连项背
E. 头痛连齿

正确答案：D。后头痛连项背

解析：足太阳之脉，起于目内眦，上额交巅，从巅络脑，还出别下项，连风府；太阳经头痛部位以后枕部疼痛为主（D对）。少阳经头痛部位以头侧为主（A错）。 阳明经头痛部位以前额、面颊、眉棱骨常见（B错）。 厥阴经头痛部位以巅顶、颜面疼痛多见（C错）。少阴头痛为头痛连齿（E错）。